室性心动过速心电图诊断的最主要依据是
A. QRS波群形态宽大畸形
B. 心室率100～250次/分
C. 心室律稍微不规则
D. 心室夺获和室性融合波
E. 房室分离，房率＞室率

正确答案：D。心室夺获和室性融合波

解析：室性心动过速是起源于希氏束分支以下的特殊传导系统或者心室肌的连续3个或3个以上的异位心搏，多见于冠心病等器质性心脏病患者，临床上多根据室速患者心电图特征性表现进行确诊。室性心动过速的心电图特征（P198）为：①3个或以上的室性期前收缩连续出现；②QRS波形态宽大畸形（A错），且时限超过0.12秒，但QRS波畸形还可见于室早、预激综合征等多种疾病中，不具有诊断特异性，故其不是室性心动过速心电图诊断的最主要依据；③心室率通常为100～250次/分（B错），心律稍微不规则（C错）。心室率升高还可见于预激综合征合并房颤等疾病，且心室律稍微不规则仅表示心室律不齐，可见于多种心律失常，都不具有诊断特异性；④心房独立活动与QRS波无固定关系，形成房室分离，偶尔个别或所有心室激动逆传夺获心房，室率＞房率（E错）；⑤室速发作时少数室上性冲动可下传心室，产生心室夺获，表现为在P波之后，提前发生一次正常的QRS波，即心室夺获与室性融合波（D对），是室性心动过速的特征性表现，其是室性心动过速心电图诊断的最主要依据。